—顺产新生儿，胎龄35周，出生体重1900g，位于同胎龄儿平均体重的第5百分位数。对该新生儿全面而准确的诊断是
A. 早产儿，极低出生体重儿
B. 早产儿，小于胎龄儿
C. 足月儿，小于胎龄儿
D. 足月儿，低出生体重儿
E. 早产儿，适于胎龄儿

正确答案：B。早产儿，小于胎龄儿

解析：—顺产新生儿，胎龄35周（﹤37周），出生体重1900g，位于同胎龄儿平均体重的第5百分位数（小于第10百分位数），全面而准确的诊断是早产儿，小于胎龄儿（B对）。